虚里按之其动微弱的病机是
A. 心阳不足
B. 心肺气绝
C. 宗气内虚
D. 外感热邪
E. 惊恐所致

正确答案：C。宗气内虚

解析：胃之大络，名曰虚里，位于左乳下心尖博动之处，是宗气的表现，宗气以胃气为本，故称作胃之大络。虚里按之其动微弱者为不及即虚，是宗气内虚之征（C对）。虚里搏动迟弱，或久病体虚而动数者，多为心阳不足（A错）。虚里按之弹手，洪大而搏，或绝而不应者，是心肺气绝（B错）。虚里动高，聚而不散者，为热甚，多见于外感热病（D错）、小儿食滞或痘疹将发之时。因惊恐（E错）、大怒或剧烈运动后，虚里动高，片刻之后即能平复如常不属病态。